眉弓的深方有
A. 上颌窦
B. 蝶窦
C. 额窦
D. 筛窦
E. 以上都不是

正确答案：C。额窦

解析：结节下方有与眶上缘平行的弓形隆起，称眉弓，其内侧份的深面有额窦（C对）。